根据《中国药典》对有毒中药的分类“有毒”中药是
A. 吴茱萸、蛇床子
B. 车前子、地肤子
C. 山豆根、制川乌
D. 马钱子、天仙子
E. 枇杷叶、侧柏叶

正确答案：C。山豆根、制川乌

解析：本题考查的是现行《中国药典》收载毒性药材和饮片的用法用量。根据《中国药典》对有毒中药的分类“有毒”中药是山豆根、制川乌（C对）。山豆根：有毒。用量3～6g；制川乌：有毒，用量1.5～3g。先煎、久煎。孕妇慎用。不宜与半夏、瓜蒌、瓜蒌子、瓜蒌皮、天花粉、川贝母、浙贝母、平贝母、伊贝母、湖北贝母、白蔹、白及同用。吴茱萸、蛇床子（A错）均有小毒。吴茱萸：有小毒。用量2～5g，外用适量。蛇床子：有小毒。用量3～10g。外用适量，多煎汤熏洗，或研末调敷。马钱子、天仙子（D错）均有大毒。马钱子：有大毒。用量0.3～0.6g，炮制后入丸散。孕妇禁用。不宜多服久服、生用；运动员慎用；有毒成分能经皮肤吸收，外用不宜大面积涂敷；天仙子：有大毒。用量0.06～0.6g。孕妇禁用。心脏病、心动过速、青光眼者禁用。车前子、地肤子（B错）与枇杷叶、侧柏叶（E错），均不属于有毒中药。